不属于苯二氮（艹卓）类药物作用特点的是
A. 具有抗焦虑作用
B. 具有外周性肌松作用
C. 具有镇静作用
D. 具有催眠作用
E. 具有癫痫持续状态

正确答案：B。具有外周性肌松作用

解析：苯二氮（艹卓）类药物作用特点：①抗焦虑作用；②镇静催眠作用；③抗惊厥、抗癫痫作用；④中枢性肌肉松弛作用；⑤其他。掌握“苯二氮?类”知识点。